某女，78岁。患高血压病10年，因感冒发热1天就诊于中医。症见发热、微恶风塞、咳嗽、头痛眩晕、目赤翳障、咽喉肿痛、便秘，舌红苔薄黄，脉浮数，医师诊断为风热感冒、肝阳上亢兼有肠热，遂决定以桑叶配菊花为基础进行组方。根据患者咳嗽、咽喉肿痛、便秘等症状，医师宜选配的药物是
A. 葛根
B. 牛蒡子
C. 板蓝根
D. 升麻
E. 蔓荆子

正确答案：B。牛蒡子

解析：本题考查的是牛蒡子的性能特点和的主治病证。根据患者咳嗽、咽喉肿痛、便秘等症状，医师宜选配的药物是牛蒡子（B对）。牛蒡子：【性能特点】本品辛散苦泄，寒清滑利，入肺、胃经。既清散风热而解表、透疹，又宣肺祛痰而利咽、止咳；还滑利二便，导热（疹）毒排出而清解消疮疹。发汗不如薄荷，长于清解热毒与滑利二便，凡风热、热毒、肺热、痰热所致病证皆宜，兼二便不利者尤佳。【主治病证】（1）风热感冒，温病初起。（2）风热或肺热咳嗽、咯痰不畅，咽喉肿痛。（3）麻疹不透，风热疹痒。（4）热毒疮肿，痄腮。葛根（A错）：【性能特点】本品甘辛轻扬升散，平而偏凉能清，入脾、胃经。既透解肌表风热、解肌退热而发表、透发疹斑，又鼓舞脾胃清阳上升而生津止渴、升阳止泻。治项背强痛与阳明头痛最宜，无论寒热虚实、有汗无汗皆可。生用升散清透并生津，煨用长于升举而少清透。【主治病证】（1）外感表证，项背强痛。（2）麻疹初起透发不畅。（3）热病烦渴，消渴证。（4）湿热泻痢初起，脾虚泄泻。板蓝根（C错）：【性能特点】本品苦泄寒清，入心、肝、胃经，药力强。善清心肝胃热毒，长于凉血利咽，为治温病斑疹吐衄及热毒咽痛、丹毒、痄腮之要药，尤善治咽喉肿痛与颜面丹毒（大头瘟疫）。【主治病证】（1）温病发热、头痛或发斑疹。（2）咽喉肿痛，痄腮，痈肿疮毒，丹毒，大头瘟疫。升麻（D错）：【性能特点】本品辛散轻浮上行，微甘微寒清解，散升清泄，入肺、脾、胃、大肠经。生用既散肌表与阳明经邪气而发表，又清泄热毒而解毒、透疹，最善治阳明头痛、疹痘斑透发不畅及热毒上攻诸证。炙用升举脾胃清阳之气，治中气下陷每用。【主治病证】（1）风热头痛，麻疹透发不畅。（2）热毒疮肿，丹毒，痄腮，咽喉肿痛，口舌生疮，温毒发斑。（3）气虚下陷之久泻脱肛、崩漏下血及胃下垂、子宫脱垂等。蔓荆子（E错）：【性能特点】本品辛散苦泄，微寒能清，质轻升浮，入膀胱、肝、胃经。上行头面，善散头面部风邪或风热之邪而清利头目，凡风在头面之疾皆可选用，兼热者尤宜；兼通络、利关节而止痛，疗痹痛拘急可投。【主治病证】（1）风热头痛、头昏，牙痛。（2）风热目赤肿痛或目昏多泪。（3）风湿痹痛，肢体拘急。